关于整复手术的技术特点中，正确的说法是
A. 严格无菌条件
B. 尽量爱护和保存组织
C. 防止或减少粗大的瘢痕形成
D. 应用显微外科技术
E. 以上都是

正确答案：E。以上都是

解析：整复手术的技术特点：①严格无菌条件；②尽量爱护和保存组织；③防止或减少粗大的瘢痕形成；④应用显微外科技术。掌握“口腔颌面部后天畸形概论”知识点。